女性12岁，突然出现左下牙咬物疼，无明显诱因自发疼1天，夜间加剧。口腔检查：恒牙，牙齿排列整齐，口腔卫生好，软垢（-），牙石（-），左下5叩痛（++），不松，最有可能引起疼痛的病因是
A. 隐匿龋
B. 牙隐裂
C. 畸形中央尖
D. 颌骨囊肿急性感染
E. 造釉细胞瘤合并感染

正确答案：C。畸形中央尖

解析：本题考查畸形中央尖。患者无软垢牙石存在，口腔卫生好，牙不松动，但出现无明显诱因的自发痛、夜间痛的急性牙髓炎表现，多考虑为中央尖折断后引起的牙髓感染，畸形中央尖（C对）多见于下颌前磨牙，一般位于（牙合）面中央窝处，呈圆锥形突起，畸形中央尖患者一般无临床症状，常在口腔检查时偶然发现，多数患者是在中央尖折断并发牙髓和根尖周炎症后而就诊。隐匿龋（A错）是指釉质脱矿从其表面下层开始，有时可在看似完整的釉质下方形成龋洞，好发于磨牙沟裂下方和邻面，一般无叩痛、咬合痛出现。牙隐裂（B错）好发于中老年患者的后牙咬牙合面，以上颌第一磨牙最为多见，患者最常见的主诉是较长时间的咀嚼不适或咬合痛，病史可长达数月甚至数年，咬在某一特殊部位可引起剧烈疼痛是该病最具特征性的症状。颌骨囊肿是指在颌骨内出现的含有液体的囊性肿物，颌骨囊肿急性感染（D错）可导致口内牙齿疼痛、松动，牙龈表面出现脓包，部分患者可有全身症状出现。造釉细胞瘤合并感染（E错）可有牙松动、移位、脱落，患者面部左右不对称，肿瘤侵犯还可发生吞咽、咀嚼和呼吸障碍。